男性，60岁。冠心病患者，稍事活动后即可有心悸气短，根据其临床表现可诊断为
A. 心功能Ⅰ级
B. 心功能Ⅱ级
C. 心功能Ⅲ级
D. 心功能Ⅳ级
E. 心功能0级伴老年性肺水肿

正确答案：C。心功能Ⅲ级

解析：患者稍事活动后即可有心悸气短，说明此患者体力活动已明显受限，低于一般活动即引起心衰症状，符合心功能Ⅲ级（C对）诊断。心功能I级（A错）患者一般活动不引起心悸气短等心衰症状。心功能Ⅱ级（B错）患者体力活动轻度受限，一般活动下才出现心悸气短等心衰症状。心功能IV级（D错）患者休息状态下也存在心悸气短等心衰症状。NYHA的心功能分级中无“心功能0级”概念（E错）。